关于抗抑郁药米氮平作用特点的说法，说法错误的是
A. 属于去甲肾上腺素能及特异性5-羟色胺能抗抑郁药
B. 不属于CYP450酶系的强效或中效抑制剂，药物相互作用风险小
C. 口服吸收快而完全
D. 对组胺H₁受体亲和力较高，具有特异性的镇静作用
E. 用药1～2天后起效

正确答案：E。用药1～2天后起效

解析：本题考查米氮平的作用特点。米氮平用药一周左右起效（E错，为本题正确答案）。米氮平为抗抑郁药，抗抑郁药作用特点如下：（1）米氮平属于去甲肾上腺素能及特异性5-羟色胺能抗抑郁药（A对）；（2）由于对组胺H₁受体亲和力较高，因此还具有特异性的镇静作用（D对），临床广泛用于治疗中性抑郁、广泛焦虑障碍和伴有紧张型头痛的抑郁症。（3）米氮平口服吸收快而完全（C对），蛋白结合率85%，可透过胎盘屏障和乳汁。（4）由于米氮平不属于CYP450酶系的强效或中效抑制剂，因此药物相互作用风险小（B对）。（5）抗抑郁药起效缓慢，大多数药物起效需要一定的时间，并且需要足够长的疗程，一般4～6周方显效，即便是起效较快的抗抑郁药如米氮平和文拉法辛，也需要1周左右的时间。